关于ATP与ADP相互转化的说法，错误的是
A. ATP末端高能磷酸键水解的同时转化为ADP
B. ADP可磷酸化生成ATP的过程需要能量
C. ATP与ADP相互转变的过程，反映体内能量的释放与贮存
D. ADP转化成ATP需要酶与能量的参与
E. 电子传递过程中释放的能量使ATP磷酸化为ADP

正确答案：E。电子传递过程中释放的能量使ATP磷酸化为ADP

解析：ATP末端的高能磷酸键水解过程中释放能量，同时生成ADP；而电子传递过程中释放的能量使ADP磷酸化生成ATP；ADP与ATP相互转变形成循环过程，反映了体内能量的释放与贮存的关系，并且均需要酶的参与。掌握“ATP”知识点。